患儿9岁，左上侧切牙牙齿变色就诊。检查：冠折牙本质暴露，牙齿变色。冷热测无反应，X线片示根尖喇叭口，骨硬板不连续，下列各项中哪项最重要
A. 拔髓，不要出根尖孔
B. 彻底去除根管内感染物质，消除炎症，保护牙乳头
C. 根管内不要封FC等刺激性大的药物
D. 用氢氧化钙糊剂充填不要超填
E. 定期复查更换糊剂

正确答案：B。彻底去除根管内感染物质，消除炎症，保护牙乳头

解析：本题考查根尖诱导成形术。患儿9岁，左上侧切牙牙齿变色就诊。检查：冠折牙本质暴露，牙齿变色。冷热测无反应，X线片示根尖喇叭口，骨硬板不连续，彻底去除根管内感染物质，消除炎症，保护牙乳头（B对）最重要。牙齿变色说明牙髓已经坏死，骨硬板不连续说明根尖周组织破坏。根尖诱导成形术是指牙根未完全形成之前发生牙髓严重病变和根尖周病变的年轻恒牙，在控制感染的基础上，用药物及手术的方法保存根尖部的牙髓或根尖周组织沉积硬组织。根尖诱导成形术的适应证：（1）牙髓炎症已波及根髓，而不能保留根髓的年轻恒牙；（2）牙髓坏死或并发根尖周炎症的年轻恒牙，因此应进行根尖诱导成形术。其所依赖的组织有根尖部残留的生活牙髓、根尖部的牙乳头及上皮根鞘，因此应进行保护。